体温高峰期热代谢的特点是
A. 产热大于散热
B. 散热大于产热
C. 产热和散热平衡
D. 产热增加
E. 散热增加

正确答案：C。产热和散热平衡

解析：当体温升高到调定点的新水平时，便不再继续上升，而是在这个与新调定点相适应的高水平上波动，所以称高温持续期。产热和散热平衡（C对）是此期热代谢的特点。产热大于散热（A错）是体温上升期的热代谢特点。散热大于产热（B错）是退热期的热代谢特点。